寿命表的主要指标不包括
A. 死亡概率
B. 尚存人数
C. 死亡人数
D. 年龄别死亡率
E. 期望寿命

正确答案：D。年龄别死亡率